构成眶内侧壁的是
A. 筛骨、泪骨、上颌骨额突
B. 额骨、筛骨、泪骨
C. 颧骨、蝶骨大翼
D. 上颌骨体上面和颧骨
E. 额骨眶板与蝶骨小翼

正确答案：A。筛骨、泪骨、上颌骨额突

解析：泪骨为菲薄的方形小骨片，位于眶内侧壁的前份 。前接上颌骨额突，后连筛骨眶板，因此构成眶内侧壁的是筛骨、泪骨、上颌骨额突（A对）。